腐殖质化是指复杂的有机物在土壤中转化为
A. 简单的化合物
B. 稳定的有机物
C. 二氧化碳和水
D. 化肥
E. 腐败的有机体

正确答案：B。稳定的有机物

解析：本题考查腐殖质化。腐殖质化是指土壤中复杂的有机物在有机质组成的细菌、真菌、放线菌和其他微生物的作用下，经过一系列的化学反应，被转化为稳定的有机物（B对ACDE错）。